开展PSA筛查前列腺癌地区的早诊早治率明显高于未开展地区，但两地区的前列腺癌死亡率相差不大，评价筛查效果时，应注意的偏倚是
A. 领先时间偏倚
B. 病程长短偏倚
C. 回忆偏倚
D. 过度诊断偏倚
E. 志愿者偏倚

正确答案：D。过度诊断偏倚

解析：本题考查过度诊断偏倚。开展PSA筛查前列腺癌地区的早诊早治率明显高于未开展地区，但两地区的前列腺癌死亡率相差不大，可能是因为筛检，这些惰性病例被发现、确诊患病、并被计入病人总体之中,导致经筛检发现的病人有较多的生存者或较长的平均生存期，从而高估了筛查效果，致使产生了过度诊断偏移（D对ABCE错）。